研究吸烟和肺癌的关系，队列研究开始，基线资料收集时，判断研究对象是否患有肺癌的目的是
A. 发现队列人群中的新病例
B. 根据暴露状态进行分组
C. 排除具有可疑混杂因素的研究对象
D. 排除已经患有目标疾病的不合格对象
E. 判断研究对象的依从程度

正确答案：D。排除已经患有目标疾病的不合格对象

解析：本题考查队列研究的相关内容。在队列研究中，所选研究对象在随访开始时必须是没有出现所研究的结局，但在随访期内有可能出现该结局（如疾病）的人群。研究吸烟和肺癌的关系，基线资料收集时，判断研究对象是否患有肺癌的目的是排除已经患有目标疾病的不合格对象（D对ABCE错）。